下列有关Vmax的叙述中，哪项正确
A. Vmax是酶完全被底物饱和时的反应速度
B. 竞争性抑制时Vmax减少
C. 非竞争抑制时Vmax增加
D. 反竞争抑制时Vmax增加
E. Vmax与底物浓度无关

正确答案：A。Vmax是酶完全被底物饱和时的反应速度